下列脉象，除哪项外，均主实证
A. 弦
B. 濡
C. 滑
D. 紧
E. 长

正确答案：B。濡

解析：濡脉即脉浮细无力而软，多见于虚证或湿困，非实证（B对）。弦脉即端直以长，如按琴弦，多见于肝胆病、痰饮、诸痛、疟疾或老年健康者，属实证（A错）。滑脉即往来流利，应指圆滑，多见于痰湿、食积、实热、青壮年或孕妇，属实证（C错）。紧脉即绷急弹指，状如转索，多见于实寒证、疼痛、宿食，属实证（D错）。长脉即首尾端直，超过本位，多见于阳证、热证、实证或平人，属实证（E错）。